适用于热结旁流的治则是
A. 热因热用
B. 寒因寒用
C. 通因通用
D. 塞因塞用
E. 寒者热之

正确答案：C。通因通用

解析：本题考查正治与反治适用证，属于理解记忆内容。通因通用，即以通治通，是指用通利的药物来治疗具有通泻症状的实证。适用于因实邪内阻出现通泄症状的真实假虚证，热结旁流乃燥屎坚结于里，胃肠欲排不能，逼迫津液从燥屎旁流下所致，故用通因通用法治疗（C对，ABDE错）。